牙髓失活法的最严重的并发症是
A. 龈乳头炎
B. 封药后疼痛
C. 化学性骨髓炎
D. 残髓炎
E. 急性牙周炎

正确答案：C。化学性骨髓炎

解析：本题考查牙髓失活法导致的最严重的并发症。牙髓失活法的最严重的并发症是化学性骨髓炎（C对）。牙髓失活法用的牙髓失活剂分为砷和多聚甲醛。失活剂对组织都有腐蚀性，当失活剂封闭不好，渗出时会烧伤组织，造成封药后疼痛（B错）和牙周组织炎症包括龈乳头炎（A错）、急性牙周炎（E错）等并发症，其中金属砷的微渗漏对组织损伤较大，严重者会导致化学性骨髓炎甚至牙槽骨坏死。残髓炎（D错）是因为牙髓失活效果不彻底导致残留有炎症的根髓，但不是最严重的并发症。